无牙颌牙槽嵴终身持续吸收，一般每年为
A. 0.5mm
B. 0.8mm
C. 1mm
D. 1.2mm
E. 1.5mm

正确答案：A。0.5mm

解析：本题考查牙槽嵴吸收。无牙颌牙槽嵴终身持续吸收，一般每年为0.5mm（A对）。牙列缺失后，会出现牙槽嵴的吸收。吸收在缺失后前3个月最快，大约6个月后吸收速度显著下降，拔牙后2年吸收速度趋于稳定，每年以0.5mm的水平吸收，将终生持续。